诊断急性菌痢必做的检查是
A. 血常规
B. 粪便常规
C. 直肠镜
D. 血培养
E. 悬滴检查

正确答案：B。粪便常规

解析：诊断急性菌痢必做的检查是粪便常规（B对）。血常规主要诊断三大疾病，具体如下：1.血小板异常：原发性血小板增多、真性红细胞增多症、慢性粒细胞白血病均可引起血小板增高。原发性血小板减少、过敏性血小板减少性紫癜、药物性血小板减少、脾功能亢进、红斑狼疮等，均可引起血小板减少；2.红细胞异常：生理性红细胞增高，如脱水、呕吐、水分丢失等。病理性红细胞增高，即真性红细胞增多症等。红细胞减少为贫血，主要指缺铁性贫血；3.白细胞异常：白细胞增高时感染较常见，持续增高或中重度增高，提示重度感染或白血病。白细胞减低，多为病毒感染，如传染性疾病等（A错）。以下病症患者是需要进行肠镜检查：1.不明原因的便血。在医学临床上，许多肠道疾病都会造成患者出现血便、脓便等症状表现，对于长期出现有此类症状的患者，需要对肠道进行检查，从而更好的对患者病变部位、病症类型、损伤程度等病症信息进行确诊。2.肠道占位性病变。如肠道息肉、大肠癌、直肠神经纤维瘤等，因为此类病症患者，需要对病变增生组织进行活体取样检查，更为有效准确对病变组织的肿瘤性质、分期等确诊判断。3.慢性肠道疾病。如慢性肠炎、克罗恩病、直肠脱垂等，对于慢性肠道疾病患者，需要定期通过肠镜检查方式，观察病症变化、治疗效果等情况，以帮助主诊医生对后续治疗方案进行调整。另外，对于乙状结肠扭转、肠套叠、慢性腹泻等病症患者，也需要根据实际病情，考虑采取肠镜检查的方式进行病情确诊（C错）。血培养指的是用患者的血液进行病原微生物的培养，看是否有细菌或真菌的生长。一般来说当出现以下几种情况时应做血培养：1.有菌血症的指征，即有不明原因的发热，体温大于38.5°或体温低于36℃或寒战。还有白细胞增多>10⁹/L或粒细胞减少。还有血压降低、休克、昏迷、多器官功能衰竭等全身感染症状体征，以及严重的局部感染、血小板减少、皮肤黏膜出血等。2.感染性心内膜炎，凡原因不明的发热持续1周以上，伴有心脏杂音或超声发现赘生物，或原有心脏基础疾病，以及人工心脏瓣膜植入术后的患者均因反复多次进行血培养。3.导管相关性感染，凡带有血管导管超过1天或导管拔除少于48小时而出现发热、寒战、低血压等全身感染症状，均应行导管血培养（D错）。悬滴检查和培养是专门用于霍乱和副霍乱的筛查试验（E错）。